原发性高血压的发生
A. 与交感肾上腺髓质系统兴奋有关
B. 与遗传易感性激活有关
C. 两者均是
D. 两者均否
E. 无

正确答案：C。两者均是

解析：交感肾上腺髓质系统兴奋（A对）和遗传易感性激活（B对，故C为本题正确答案）与原发性高血压的发生有关。